患者，男，74岁，青光眼病史5年，近期诊断为支气管哮喘。应慎用的药物是
A. 孟鲁司特钠片
B. 沙丁胺醇气雾剂
C. 氨茶碱缓释片
D. 布地奈德气雾剂
E. 异丙托溴铵气雾剂

正确答案：E。异丙托溴铵气雾剂

解析：本题考查异丙托溴铵。应慎用的药物是异丙托溴铵气雾剂（E对）。异丙托溴铵属于短效抗胆碱药，主要用于哮喘急性发作的治疗，多与β₂受体激动剂联合应用，尤其适用于夜间哮喘及痰多的患者。主要不良反应有头痛、恶心、口干、心悸、眼压增高、胃肠道蠕动紊乱、尿潴留等，闭角型青光眼患者禁用。孟鲁司特钠片（A错）可用于轻度哮喘糖皮质激素的替代治疗，尤其适用于阿司匹林哮喘和伴有过敏性鼻炎患者的治疗，对12岁以下儿童、妊娠及哺乳妇女宜在权衡利弊后慎重应用。沙丁胺醇气雾剂（B错）是治疗哮喘急性发作的首选用药，与氨茶碱合用对急性哮喘治疗作用加强。沙丁胺醇对心血管功能不全、高血压、甲状腺功能亢进患者及妊娠期妇女慎用，对老年人及对β₂受体激动剂敏感者慎用。氨茶碱缓释片（C错）属于磷酸二脂酶抑制剂，在体内释放出茶碱，用作平喘。氨茶碱的不良反应有恶心、呕吐、心律失常、血压下降及多尿等，个体差异大，应进行血药浓度监测，对急性心肌梗死者禁用。布地奈德气雾剂（D错）是吸入性糖皮质激素，用于哮喘的治疗。通常需要吸入1～2周以上方能见效，因其会出现口咽白色念珠菌感染、声音嘶哑症状，吸药后用清水漱口可以有效缓解局部反应和胃肠吸收。